生物效应剂量属于
A. 效应性生物标志物
B. 接触性生物标志物
C. 易感性标志物
D. 内剂量
E. 外剂量

正确答案：B。接触性生物标志物